根据《医疗用毒性药品管理办法》，关于毒性药品的管理和使用的说法，正确的是
A. 采购的毒性中药材，包装材料上无须标上毒性药标志
B. 擅自收购毒性药品，可处没收非法所得，并处以警告
C. 调配处方时，对处方未标明“生用”的毒性中药，应当付以炮制品
D. 医疗单位供应和调配毒性药品每次处方剂量不得超过三日剂量
E. 科研和教学单位所需的毒性药品，持本单位的证明信，供应部门方能发售

正确答案：C。调配处方时，对处方未标明“生用”的毒性中药，应当付以炮制品

解析：本题考查医疗用毒性药品使用和调配要求。根据《医疗用毒性药品管理办法》，关于毒性药品的管理和使用的说法，正确的是调配处方时，对处方未标明“生用”的毒性中药，应当付以炮制品（C对）。医疗机构供应和调配毒性药品，须凭执业医师签名的正式处方。调配处方时，必须认真负责，计量准确，按医嘱注明要求，并由配方人员及具有药师以上技术职称的复核人员签名盖章后方可发出。对处方未注明“生用”的毒性中药，应当付炮制品。如发现处方有疑问时，须经原处方医生重新审定后再行调配。处方一次有效，取药后处方保存2年备查。毒性药品的生产企业须按审批的生产计划进行生产，不得擅自改变生产计划，自行销售。毒性药品的包装容器上必须印有毒药标志（A错），在运输毒性药品的过程中，应当采取有效措施，防止发生事故。违反毒性药品管理规定的法律责任：医疗用毒性药品（以下简称毒性药品），系指毒性剧烈、治疗剂量与中毒剂量相近，使用不当会致人中毒或死亡的药品。根据《医疗用毒性药品管理办法》第11条的规定，对违反规定擅自生产、收购、经营毒性药品的单位或者个人，应没收其全部毒性药品，并给予警告或按照非法所得的五至十倍罚款（B错）；情节严重、致人伤残或死亡，构成犯罪的，依法追究刑事责任。《医疗用毒性药品管理办法》第九条：医疗单位供应和调配毒性药品，凭医生签名的正式处方。国营药店供应和调配毒性药品，凭盖有医生所在的医疗单位公章的正式处方。每次处方剂量不得超过二日极量（D错）。科研和教学单位所需的毒性药品，必须持本单位的证明信，经单位所在地县级以上药品监督管理部门批准后，供应单位方能发售（E错）。